除癫痫外，苯妥英钠还可用于
A. 尿崩症
B. 心律失常
C. 帕金森病
D. 心绞痛
E. 失眠

正确答案：B。心律失常

解析：苯妥英纳临床应用①癫痫②神经疼痛综合征③心律失常（B对）。